患者，男，48岁，长期饮食不规律且发作性餐后上腹疼痛。诊断：胃溃疡，Hp（+）。拟采用四联方案根除幽门螺杆菌。关于该患者的药物治疗与健康教育，说法正确的有
A. 如根除失败，建议3～6个月后再次根除治疗
B. 提倡分餐制，夹菜时使用公筷
C. 根除治疗结束2周后复查Hp
D. 根除治疗期间出现消化道症状，但通常是轻微而短暂的
E. 根除Hp可以去除病因，无需继续服用抑酸药治疗胃溃疡

正确答案：A、B、D。如根除失败，建议3～6个月后再次根除治疗；提倡分餐制，夹菜时使用公筷；根除治疗期间出现消化道症状，但通常是轻微而短暂的

解析：本题考查消化性溃疡的用药注意事项与患者教育。根除效果通常采用尿素呼气试验进行评估，时间在根除治疗结束后4～8周（C错）。如为补救治疗，建议两次根除治疗间隔3～6个月（A对）。根除治疗中，有些患者会出现消化道症状，如口苦、恶心、腹痛、腹泻、黑便等，这些不良反应通常都是轻微而短暂的（D对），停药之后可恢复。幽门螺杆菌感染往往有家庭聚集性，为根除彻底和避免再感染，应该进行积极的治疗和预防，避免共用餐具而导致病原菌传染，提倡分餐制，夹菜时使用公筷（B对），不共用水杯、牙刷等。建议其他家庭成员同时进行检查，对检查阳性者进行根除治疗。